患者男，50岁。直肠二度脱垂，治疗首选
A. 结扎疗法
B. 手术疗法
C. 中药熏洗
D. 挂线疗法
E. 注射疗法

正确答案：E。注射疗法

解析：直肠周围注射法适用于直肠二度脱垂，使直肠壁与周围组织（两侧直肠侧韧带和后方的骶前筋膜）粘连固定而不脱出肛外（E对）。结扎法常用于Ⅱ、Ⅲ期内痔，尤其是纤维型内痔更为适宜（A错）。直肠脱垂手术疗法包括直肠悬吊固定术（适用于完全性直肠脱垂合并乙状结肠脱垂）、肛门紧缩术（适用于完全性直肠脱垂伴肛门松弛者）、脱出肠管切除术（适用于脱出肠管出现水肿、坏死或粘连不能还纳肛门）（B错）。中药熏洗可以作为直肠脱垂的辅助疗法，一般不作为首选（C错）。挂线疗法适用于距离肛门3～5厘米以内，可探及内口的肛瘘，复杂性高位肛瘘治疗的辅助方法（D错）。